患儿，11岁，女。患甲状腺癌，并有颈淋巴结转移。医生告诉患儿母亲，女孩需做甲状腺癌根治术，按常规手术后要造成颈部塌陷变形、肩下垂，身体的外观和功能都要受到一定损害。当患儿母亲听到要造成这此后遗症后，断然拒绝治疗，带孩子出院。过了不久，患儿家属考虑到癌症将危及患者的生命，故再次来到医院，要求给子治疗，并请求医生尽可能不给孩子留下终身伤残的痛苦。医生经过再三考虑，决定打破常规，采用一种新的术式，既收到治疗效果，又使女孩子保留外形美观，功能不受破坏。患者及家属同意做此手术，尽管这种术式的治疗效果当时尚不能肯定。手术进行得很顺利，随访远期疗效也很好。下面说法，哪一点是错误的
A. 患者应该在医师指导下对治疗作出负责的决定并与医师合作执行
B. 既要为患者考虑眼前疗效，又考虑远期疗效
C. 医生不可以强求患者做不同意做的手术
D. 医生打破常规，采用治疗效果不肯定的术式的做法是不可取的
E. 医生为患者着想、勇担风险是值得赞扬的

正确答案：D。医生打破常规，采用治疗效果不肯定的术式的做法是不可取的